钙化程度低，窄而细长，数量较釉丛少，在釉质横断片中容易观察呈裂隙状结构的是
A. 釉板
B. 釉丛
C. 绞釉
D. 釉质横纹
E. 芮氏线

正确答案：A。釉板

解析：釉板在磨片中观察呈裂隙状结构。釉板钙化程度低、窄而细长，数量较釉丛少，在釉质横断面容易观察。掌握“牙釉质”知识点。